关于伤寒病原学的叙述，不正确的是
A. 革兰染色阴性
B. “Vi”抗体有助于诊断
C. 属于沙门菌属的D组
D. 其内毒素是致病的重要因素
E. 本菌有“O”、“H”和“Vi”抗原

正确答案：B。“Vi”抗体有助于诊断

解析：“Vi”抗体并不有助于诊断（B错，为本题正确答案），它只是对带菌者具有诊断参考价值（P149）。革兰染色阴性（A对）、属于沙门菌属的D组（C对）、其内毒素是致病的重要因素（D对）、本菌有“O”、“H”和“Vi”抗原（E对）均为伤寒沙门菌的病原学特点。